肺脓肿的常见病原体是
A. 腺病毒
B. 金黄色葡萄球菌
C. 呼吸道合胞病毒
D. 肺炎链球菌
E. 肺炎支原体

正确答案：B。金黄色葡萄球菌

解析：肺脓肿的常见病原体包括厌氧菌、金黄色葡萄球菌（B对）、化脓性链球菌、肺炎克雷伯杆菌和铜绿假单胞菌等。腺病毒（A错）、呼吸道合胞病毒（C错）、肺炎链球菌（D错）、肺炎支原体（E错）均不是肺脓肿的常见病原体。